男，45岁。右脚心被铁钉刺伤24小时，伤处红肿，剧痛，周围边界不清，创口中心皮肤坏死。最可能感染的致病菌是
A. 梭状芽孢杆菌
B. 表皮葡萄球菌
C. 铜绿假单胞菌
D. 金黄色葡萄球菌
E. β-溶血性链球菌

正确答案：A。梭状芽孢杆菌

解析：患者脚心被铁钉刺伤后（深部刺伤，创口小，易形成厌氧环境）未做处理，24小时后伤处红肿，剧痛，周围边界不清，创口中心皮肤坏死，最可能感染的致病菌为梭状芽孢杆菌（A对）。梭状芽孢杆菌为厌氧菌，伤后污染此菌机会很多，创伤后感染此菌发生气性坏疽的时间通常在伤后1～4日，病人常诉伤肢沉重或疼痛，持续加重，有如胀裂，程度常超过创伤伤口所能引起者。表皮葡萄球菌（B错）、铜绿假单胞菌（C错）为条件致病菌，是院内感染的主要病因，其引起的感染通常发生于衰弱或免疫受损的病人。金黄色葡萄球菌（D错）是常见的化脓性球菌，是医院交叉感染的重要来源，可通过皮肤、消化道等途径感染，一般不由外伤引起。β-溶血性链球菌（E错）常引起组织的蜂窝织炎、淋巴管炎、丹毒等。